编制寿命表时，下列指标中，可从实际调查中直接获得的是
A. 死亡概率nqx
B. 死亡率nmx
C. 死亡人数ndx
D. 尚存人数lx
E. 平均人口数nPx

正确答案：E。平均人口数nPx